面部疖痈易发生全身并发症的原因，除外
A. 病原菌毒力强
B. 静脉多无瓣膜
C. 颜面部血液循环丰富
D. 颜面表情肌的活动
E. 感染侵入面静脉时血栓形成，致静脉回流受阻

正确答案：E。感染侵入面静脉时血栓形成，致静脉回流受阻

解析：本题考查面部疖痈易发生全身并发症的原因。当感染侵及面静脉时血栓形成时，静脉回流受阻（E错，为本题的正确答案），可出现颜面部广泛水肿、疼痛。疖痈是单个或多个毛囊及其附件同时发生急性化脓性炎症者。在颌面部感染中，面部疖痈最易发生全身并发症，主要病原菌是金黄色葡萄球菌，病原菌毒力强（A对）。面部血液循环丰富（C对），感染沿无瓣膜面静脉（B对）逆行引起海绵窦血栓性静脉炎，常表现患侧眼睑水肿、眼球突出、眼压升高等症状。颜面表情肌活动易使感染扩散，引起菌血症或脓毒症等并发症（D对）。